首先考虑功能性消化不良的临床表现是
A. 吞咽困难
B. 上腹痛伴贫血
C. 反复反酸、烧心伴胸痛
D. 突发上腹刀割样疼痛向腰背部放射
E. 间断餐后上腹部胀痛伴嗳气，不影响睡眠

正确答案：E。间断餐后上腹部胀痛伴嗳气，不影响睡眠

解析：功能性消化不良（FD）（P384）是指由胃和十二指肠功能紊乱引起，但没有器质性改变的胃肠道功能性疾病，临床表现是间断餐后腹胀、上腹部胀痛伴嗳气，不影响睡眠（E对）。吞咽困难（A错）主要见于炎症或癌肿所导致的食管狭窄。上腹痛伴贫血（B错）多见于胃病伴长期营养吸收障碍或慢性消化道出血；反复反酸、烧心伴胸痛（C错）（P347）主要见于胃食管反流病；突发上腹刀割样疼痛向腰背部放射（D错）（P430）主要见于急性胰腺炎。